牙内陷最严重的情况是
A. 畸形舌侧窝
B. 牙中牙
C. 畸形根面沟
D. 畸形舌侧尖
E. 锥形牙

正确答案：B。牙中牙

解析：本题考查牙内陷。牙内陷最严重的情况是牙中牙（B对）。牙内陷为牙发育时期，成釉器过度卷叠或局部过度增殖，深入到牙乳头中所致。根据牙内陷的深浅程度及其形态变异，临床上可分为：畸形舌侧窝，畸形根面沟，畸形舌侧尖和牙中牙，其中畸形舌侧窝是最轻的一种（A错），牙中牙是最严重的一种（B对CD错）。如牙呈锥形时称为锥形牙，不属于牙内陷（E错）。